寒痰形成的病机是
A. 寒伤阳气，气不化津
B. 热邪煎熬，炼液成痰
C. 外感风寒，肺失宣肃
D. 肝风夹痰
E. 脾虚生湿，湿聚成痰

正确答案：A。寒伤阳气，气不化津

解析：寒痰因寒邪阻肺，使肺内津液凝聚成痰，或脾阳不足，湿聚为痰，上犯于肺所致（A对）。因邪热犯肺，热邪煎熬，炼液成痰，痰黄质黏稠，甚则结块者，多属热痰（B错）。外感风寒，肺失宣肃，津液不布，可见痰稀色白，属于生成痰的病因（C错）。肝风夹痰，阻滞络脉，经气不利，则口眼斜，半身不遂，舌强语謇（D错）。脾失健运，水湿内停，湿聚成痰，多属湿痰（E错）。